产褥妇，26岁。剖宫产术后16天，突然阴道大量流血3小时来院。入院时BP84/60mmHg，心率122次/分，Hb84g/L。该患者最可能的出血原因是
A. 胎盘附着面复旧不全
B. 胎盘胎膜残留
C. 胎盘附着面血栓脱落
D. 继发性子宫收缩乏力
E. 子宫切口裂开出血

正确答案：E。子宫切口裂开出血

解析：该产褥妇，剖宫产术后16日（＞24小时），突然阴道大量流血3小时来院，入院时BP84/60mmHg（血压低于90/60mmHg为低血压），心率122次/分（正常心率为60～100次/分，该患者心动过速），Hb84g/L（正常血红蛋白含量为115～150g/L），诊断为晚期产后出血。该患者有剖宫产史，并出现休克症状，最可能的出血原因是子宫切口裂开出血（E对）。胎盘附着面复旧不全（A错）多发生在产后2周左右，表现为突然大量阴道流血，检查发现子宫大而软，宫口松弛，阴道及宫口有血块堵塞。胎盘附着面血栓脱落（C错）属于胎盘附着面复旧不全。胎盘胎膜残留（B错）为阴道分娩后晚期产后出血最常见的原因。继发性子宫收缩乏力（P211）（D错）是产后出血最常见的原因，不引起晚期产后出血。